虚则补之属于
A. 逆治法
B. 反治法
C. 治标法
D. 从治法
E. 治本法

正确答案：A。逆治法

解析：逆治法指采用与证候性质相反的方药进行治疗的治则；虚则补之是指用补益方药或具有补益功效的措施而治疗虚性性病证的治法，属于逆治法，也称正治法（A对）。反治法指顺从病证的外在假象而治的治则，由于采用的方药性质与病证中假象的性质相同，故又称为“从治”（BD错）。治标法指“标”危急，先采用治标的原则（C错）；治本法指标症不急时，针对本病治疗（E错）。